呈对数正态分布的数值变量资料，描述集中趋势的指标最好选用
A. 几何均数
B. 众数
C. 算术均数
D. 调和均数
E. 中位数

正确答案：A。几何均数

解析：（P10）算术均数在计算时用到了每一个观察值，在偏态较大的情况下，算出的均值很容易受到频数分布尾端极大或极小值的影响，不能真正的反映分布的集中位置，这是应考虑改用其他方法（C错）。（P11）几何均数在计算时要注意观察值中不能有零或负数，否则在做对数变换之前需要加一个常数。（A对）。（P13）中位数…都能用来反映一组数据的集中趋势或平均水平，由于中位数的确定仅取决于它在数据序列中的位置，而不是由全部观察值综合计算得出，因此不受少数特大或特小只值的影响，在这一点上，它优于均数…中位数还有一个很大的缺点，即不便于做统计运算…因此在统计分析中，中位数不如均数应用广泛（E错）